酸雨形成的主要污染物是
A. 氯氟烃
B. 烟尘
C. CO₂
D. SO₂、颗粒物
E. SO₂、NOₓ

正确答案：E。SO₂、NOₓ

解析：本题考查酸雨形成的主要污染物。酸雨是指溶解在大气降水中的酸性物质，其主要污染物是SO₂和NOₓ（E对ABCD错）。